可与对氨基苯甲酸竞争二氢叶酸合成酶，阻碍叶酸合成的药物是
A. 磺胺嘧啶
B. 氧氟沙星
C. 利福平
D. 两性霉素
E. 红霉素

正确答案：A。磺胺嘧啶

解析：本题考查磺胺嘧啶的作用机制。磺胺嘧啶（A对）为磺胺类药，与对氨基苯甲酸（PABA）化学结构相似，可与PABA竞争二氢叶酸合成酶，阻止二氢叶酸的合成，继而使二氢叶酸和四氢叶酸合成减少，RNA和DNA合成受阻，最终抑制细菌生长繁殖。氧氟沙星（B错）用于治疗细菌性结膜炎、角膜炎、角膜溃疡、泪囊炎、术后感染等外眼感染。利福平（C错）的抗菌作用机制是特异性抑制敏感微生物的DNA依赖性RNA聚合酶，阻碍其mRNA的合成，而对人细胞的此酶则无影响。两性霉素B（D错）为多烯类药，可与真菌细胞膜上的麦角固醇结合，使细胞膜上形成微孔，从而改变细胞膜的通透性，可引起细胞内重要物质的外漏，无用物或对其有毒物质内渗而致真菌死亡。红霉素（E错）属大环内酯类，大环内脂类抗菌药物与敏感菌核蛋白体结合，竞争性阻断了肽链延伸过程中的转肽作用和mRNA位移。